具有先后天关系的两脏是
A. 肺与肾
B. 肺与脾
C. 肺与肝
D. 肺与心
E. 脾与肾

正确答案：E。脾与肾

解析：肺与肾之间的关系主要表现为呼吸运动、水液代谢和阴阳互资等方面。在呼吸方面，肺为呼吸器官，通过肺的呼浊吸清，吐故纳新，完成体内外气体的交换。但肺的呼吸功能，必须依赖于肾主纳气的作用才得以正常发挥。中医学认为，由于肺吸入的清气，必须下行至肾，由肾摄纳之，从而保证呼吸运动的平稳，有利于气体的交换，故“肺为气之主，肾为气之根，肺主出气，肾主纳气，阴阳相交，呼吸乃和”（A错）。肺与脾的关系，主要表现在气的生成与水液代谢两个方面。在气的生成方面，肺主呼吸，通过肺的呼吸，吸入自然界清气，脾主运化，通过脾的运化，摄入水谷精微之气。清气与水谷精微之气生成宗气并积于胸中，宗气与元气合为一身之气（B错）。肺与肝的相互关系，主要表现在人体气机升降的调节方面。在生理上，肺位于膈上，主肃降，应秋气，其气以下降为顺；肝位于下焦，主升发，应春气，其气以上升为和。肝升肺降，相反相成，维持人体气机的调畅，是谓“肝升于左，肺降于右”（C错）。心与肺的关系主要表现在血液运行与呼吸吐纳之间的协同调节关系。肺助心行血，心血布散肺气，宗气为联结心主行血与肺主呼吸之间的中心环节，宗气“能贯心脉而行呼吸”，有利于维持血液循环与呼吸吐纳之间的协调平衡，血液运行与呼吸吐纳是相互关联的（D错）。肾为先天之本，脾为后天之本，故脾肾为具有先后关系的两脏，其余选项均无明显先后关系（E对）。